能爬台阶，会表示大小便的年龄是
A. 9个月
B. 18个月
C. 10～11个月
D. 7～8个月
E. 6个月

正确答案：B。18个月

解析：1.5岁后会蹲着玩，爬台阶，有目标地扔皮球。会表示大小便，会自己进食。掌握“体格生长常用指标”知识点。